Ⅰ型观测线的倒凹主要在
A. 基牙的近缺隙侧，远缺隙侧倒凹很小
B. 基牙的远缺隙侧，近缺隙侧倒凹很小
C. 基牙的近、远缺隙侧均有大倒凹
D. 基牙的近、远缺隙侧均无大倒凹
E. 近缺隙的邻面

正确答案：B。基牙的远缺隙侧，近缺隙侧倒凹很小

解析：本题考查观测线与倒凹。观测线又称导线，是分析杆与基牙颊面或舌面触点的连线，观测线（牙合）方是非倒凹区，龈方是倒凹区。Ⅰ型观测线是基牙向缺隙相反方向倾斜时所画出的导线，则倒凹主要在基牙的远缺隙侧，近缺隙侧倒凹很小（B对）。倒凹主要在基牙的近缺隙侧，远缺隙侧倒凹很小（A错）是Ⅱ型观测线，为基牙向缺隙方向倾斜时所画出的导线。当基牙的近远中均有明显倒凹或向颊、舌侧倾斜时所形成的导线为Ⅲ型导线，此时基牙的近、远缺隙侧均有大倒凹（C错）。画观测线的目的就是为了调整基牙的方向将倒凹集中在一侧（颊侧或舌侧）（D错）获得有利倒凹，倒凹在邻面（E错）是没有临床意义的。